病人角色所具有的特征主要表现为
A. 与医疗系统发生关系
B. 求医行为
C. 有疾病行为
D. 治疗行为
E. 以上都包括

正确答案：E。以上都包括

解析：本题考查病人角色具有的特征。病人角色所具有的特征主要表现为与医疗系统发生关系（A对）、求医行为（B对）、有疾病行为（C对）、治疗行为（D对）。（ABCD均对，故E为本题的正确答案）。